X线检查一般不用于
A. 浅龋
B. 深龋
C. 牙折
D. 慢性根尖周炎
E. 牙髓疼痛

正确答案：E。牙髓疼痛

解析：牙髓疼痛与X线检查无关系。掌握“龋病的诊断及鉴别诊断”知识点。